儿童使用第一代抗组胺药时相比成年人易产生较强镇静作用，该现象称为
A. 药物选择性
B. 耐受性
C. 依赖性
D. 高敏性
E. 药物特异性

正确答案：D。高敏性

解析：本题考查高敏性。儿童使用第一代抗组胺药时相比成年人易产生较强镇静作用，该现象称为高敏性（D对）。个体之间用药的效果存在个体差异，有些个体对药物的反应非常敏感，所需药量低于常用量，此称为高敏性。如果需要用高于常用量的药量才能出现药物效应，就称为低敏性。机体不同器官、组织对药物的敏感性表现明显的差异，对某一器官、组织作用特别强，而对其他组织的作用很弱，甚至对相邻的细胞也不产生影响，这种现象称为药物作用的选择性（A错）。耐受性（B错）是指人体对药物反应性降低的一种状态，按其性质有先天性和后天获得性之分。药物依赖性（C错）一般是指在长期应用某种药物后，机体对这种药物产生了生理性或精神性的依赖和需求，分生理依赖和精神依赖两种。特异质（E错）反应是由于用药者有先天性遗传异常，对于某些药物反应特别敏感，出现的反应性质可能与某些常人不同的反应。